在评价儿童现实营养状况时，除了国际上通用的方法外，日前学术界还常用哪一指标
A. 克托莱指数
B. BMI指数
C. 劳雷尔指数
D. 身高坐高指数
E. Livi指数

正确答案：B。BMI指数